下列腧穴中，归经错误的是
A. 合谷-大肠经
B. 太溪-肝经
C. 列缺-肺经
D. 阳陵泉-胆经
E. 阴陵泉-脾经

正确答案：B。太溪-肝经

解析：太溪-足少阴肾经；输穴（B错，为本题正确答案）。合谷-手阳明大肠经原穴（A对）；列缺-手太阴肺经络穴（C对）；阳陵泉-足少阳胆经合穴（D对）；阴陵泉-足太阴脾经合穴（E对）。